以下裂纹舌的主要表现中，不恰当的是
A. 沟纹的深浅、长短不一
B. 在舌背的纵、横沟纹
C. 随着年龄的增长可逐渐加重
D. 男性多发于女性
E. 常与地图舌同时存在

正确答案：D。男性多发于女性

解析：沟纹舌又名裂纹舌，主要表现为舌背的纵、横沟纹，沟纹的深浅、长短不一，随着年龄的增长可逐渐加重。常与地图舌同时存在。沟纹舌无性别差异。掌握“地图舌、沟纹舌及舌乳头炎”知识点。